在职业性中毒中，生产性毒物主要通过下述哪种途径进入体内
A. 消化道
B. 皮肤
C. 呼吸道
D. 毛囊
E. 汗腺

正确答案：C。呼吸道

解析：肺泡呼吸膜极薄，扩散面积大，供血丰富，呈气体、蒸气和气溶胶状态的毒物均可经呼吸道吸收进入人体，因此，大部分生产性毒物均由此途径吸收进入人体而导致中毒（C对）。皮肤对外来化合物是具有屏障作用的（B错）。在生产过程中，毒物经消化道摄入所致的职业中毒甚为少见，常见于事故性误服（A错）。